妊娠禁用药的是
A. 木通
B. 红花
C. 大黄
D. 附子
E. 莪术

正确答案：E。莪术

解析：莪术为破血消癥药，辛、苦、温，入肝、脾经，可破血行气、消积止痛，同三棱、水蛭、虻虫、斑蝥皆属于孕妇禁用（E对）。木通、红花、大黄、附子皆属于孕妇慎用药（ABCD错）。